有下降软腭，上提舌根作用的是
A. 舌腭肌
B. 咽腭肌
C. 悬雍垂肌
D. 腭帆张肌
E. 腭帆提肌

正确答案：A。舌腭肌

解析：舌腭肌：作用为下降软腭，上提舌根。掌握“腭、舌、舌下区的局部解剖”知识点。